在舌背黏膜的乳头上
A. 只是丝状乳头有味蕾
B. 只是菌状乳头有味蕾
C. 只是轮廓乳头有味蕾
D. 丝状乳头、菌状乳头有味蕾
E. 菌状乳头、轮廓乳头有味蕾

正确答案：E。菌状乳头、轮廓乳头有味蕾

解析：丝状乳头无味蕾(AD错)，菌状乳头、轮廓乳头、叶状乳头均有味蕾(BC错E对)。